腹壁前下部的肌肉由下列何神经支配
A. 肋下神经
B. 髂腹下神经
C. 髂腹股沟神经和髂腹下神经
D. 股神经和闭孔神经
E. 无

正确答案：C。髂腹股沟神经和髂腹下神经

解析：髂腹下神经分布于腹壁诸肌，髂腹股沟神分布于附近的腹壁肌（C对）。股神经主要分布于髂肌、耻骨肌、股四头肌和缝匠肌，闭孔神经主要支配闭孔外肌、长收肌、短收肌、大收肌和股薄肌，偶见发出分支至耻骨肌（D错）。